关于遗传性乳光牙本质的说法，以下叙述错误的是
A. 萌出时，牙外形异常
B. 萌出时牙呈乳光的琥珀样外观
C. 随着萌出逐渐变成半透明
D. 最终牙体呈灰色或棕色
E. 伴有釉质上的淡蓝色反光

正确答案：A。萌出时，牙外形异常

解析：遗传性乳光牙本质的患牙在萌出时，牙外形正常，但呈乳光的琥珀样外观。以后，牙颜色几乎正常，之后，逐渐变成半透明，最终呈灰色或棕色，伴有釉质上的淡蓝色反光。掌握“氟牙症、先天性梅毒牙与牙本质形成缺陷”知识点。